下列各项，不属阴道口中医名称的是
A. 廷孔
B. 四边
C. 子门
D. 龙门
E. 胞门

正确答案：C。子门

解析：玉门，古称廷孔，即阴道口，是玉门的最早名称（A错）。四边，即前起阴蒂，后至阴唇系带，左右大、小阴唇之间，阴道口外的前后左右，故称之为“四边”，后是很少用“四边”，多用“阴户”之名称（B错）。子门，又名子户。子门是指子宫颈口的部位，阴道、子门是女性内生殖器官的一部分。“子门”一词最早见于《内经》。《类经》注释说：“子门，即子宫之门也”（C对）。古人也有根据婚嫁、产与未产的不同，对阴道口又冠以不同的命名，如《诸病源候论·卷三十七》说：“已产属胞门，未产属龙门，未嫁属玉门（DE错）。